濡脉和弱脉的主要不同点，在于
A. 脉位的浮沉
B. 脉力的大小
C. 脉形的长短
D. 脉率的快慢
E. 脉律的齐否

正确答案：A。脉位的浮沉

解析：濡脉的脉象特点是位浮、形细、势软。其脉管搏动的部位在浅表，形细势软而无力，如絮浮水，轻取即得，重按不显，故又称软脉。弱脉的脉象特点是位沉、形细、势软。由于脉管细小不充盈，其搏动部位在皮肉之下靠近筋骨处，指下感到细而无力，故濡脉和弱脉的主要不同点在于脉位的浮沉（A对）。濡脉和弱脉的主要不同点在脉力的大小（B错）。长脉与短脉的主要不同点在于脉形的长短（C错）。结脉和促脉的主要不同点在于脉率的快慢（D错）。结脉和代脉的主要不同点在于脉率的齐否（E错）。